以上TNM分类法中，临床一期为
A. T1N2M1
B. T1N0M0
C. T2N0M0
D. T1N2M0
E. T2N1M0

正确答案：B。T1N0M0

解析：掌握“口腔颌面部肿瘤的治疗原则及预防”知识点。